患有高血压伴充血性心力衰竭同时患有肾上腺嗜铬细胞瘤和外周血管痉挛性疾病，应选用治疗的药物是
A. 强心苷
B. 糖皮质激素
C. 血管紧张素转化酶抑制剂
D. 酚妥拉明
E. 哌唑嗪

正确答案：D。酚妥拉明

解析：本题考查嗜铬细胞瘤的治疗。患有高血压伴充血性心力衰竭同时患有肾上腺嗜铬细胞瘤和外周血管痉挛性疾病，应选用治疗的药物是酚妥拉明（D对）。